某男，75岁。近1月余，耳鸣如蝉昼夜不息，安静时尤甚，听力逐渐下降，伴有腰膝酸软，头晕目眩，偶有虚烦失眠，夜尿频多；舌淡红少苔，脉细弱。宜选用的基础方剂是
A. 天王补心丹
B. 龙胆泻肝汤
C. 益气聪明汤
D. 耳聋左慈丸
E. 人参养荣汤

正确答案：D。耳聋左慈丸

解析：本题考查的是肾精亏损证的基础方剂。某男，75岁。近1月余，耳鸣如蝉昼夜不息，安静时尤甚，听力逐渐下降，伴有腰膝酸软，头晕目眩，偶有虚烦失眠，夜尿频多；舌淡红少苔，脉细弱。宜选用的基础方剂是耳聋左慈丸（D对）。肾精亏损证【症状】耳鸣或耳聋久发，耳鸣如蝉，昼夜不息，安静时尤甚，听力逐渐下降，伴有腰膝酸软，头晕目眩，或虚烦失眠，夜尿频多。舌淡红，少苔，脉细弱。【方剂应用】基础方剂耳聋左慈丸（磁石、熟地、山药、茯苓、泽泻、丹皮、山茱萸、竹叶柴胡）加减。阴虚火旺证【症状】心悸易惊，心烦失眠，五心烦热，口干，盗汗，思虑劳心则症状加重，伴耳鸣腰酸，头晕目眩，急躁易怒。舌红少津，苔少或无，脉细数。【方剂应用】基础方剂天王补心丹（A错）（人参、玄参、丹参、茯苓、五味子、远志、桔梗、当归、天冬、麦冬、柏子仁、酸枣仁、生地黄、朱砂）加减。肝胆湿热证【症状】胁肋重着疼痛或灼热疼痛，口苦口黏，胸闷纳呆，恶心呕吐，小便黄赤，大便不爽，或兼有身热恶寒，身目发黄。舌红苔黄腻，脉弦滑数。【方剂应用】基础方剂龙胆泻肝汤（B错）（龙胆、泽泻、木通、车前子、当归、柴胡、生地黄、黄芩、栀子、生甘草）加减。脾胃虚弱证【症状】耳鸣或耳聋日久，耳鸣声低，每遇疲劳加重，伴有倦怠乏力，头晕目眩，纳差便溏，或失眠健忘，面色无华。舌质淡，苔白，脉细弱或沉弱。【方剂应用】基础方剂益气聪明汤（C错）（黄芪、甘草、芍药、黄柏、人参、升麻、葛根、蔓荆子）加减。气阴两虚证【症状】胸闷隐痛，时作时止，心悸气短，动则益甚，伴倦怠懒言，易汗出，头晕，失眠多梦。舌红或淡红，舌体胖且边有齿痕，苔薄白或少，脉细缓或结代。【方剂应用】基础方剂生脉散（人参、麦冬、五味子）合人参养荣汤（E错）（人参、熟地黄、当归、白芍、白术、茯苓、黄芪、陈皮、五味子、桂心、远志、炙甘草）加减。